在药物安全指标中，药物安全范围指的是
A. ED₅和LD₉₅之间的距离
B. ED₉₅和LD₅之间的距离
C. ED₁和LD₉₉之间的距离
D. ED₅₀和LD₅₀之间的距离
E. ED₉₉和LD₁之间的距离

正确答案：B。ED₉₅和LD₅之间的距离

解析：本题考查药物安全范围。在药物安全指标中，药物安全范围指的是ED₉₅和LD₅之间的距离（B对）。较好的药物安全指标是ED₉₅和LD₅之间的距离，称为药物安全范围，其值越大越安全。药物LD₅₀和ED₅₀的比值（D错）表示药物的安全性，称为治疗指数（TI）。